以下致龋最弱的糖是
A. 蔗糖
B. 葡萄糖
C. 麦芽糖
D. 淀粉
E. 果糖

正确答案：D。淀粉

解析：本题考查龋病发生的食物因素。以下致龋最弱的糖是淀粉（D对）。食物中的多糖不易被细菌利用，致龋力更低。常见多糖有淀粉和膳食纤维。淀粉是D-葡萄糖单体组成的同聚物，包括直链淀粉和支链淀粉两种类型，是植物中糖类的主要贮存形式。只有烹饪加热，链状结构破坏，淀粉才能被唾液和细菌淀粉酶代谢，水解为麦芽糖、麦芽三糖和低分子量糊精。蔗糖（A错）：是重要的致龋物质，作为细菌代谢的底物，在代谢过程中，为细菌提供营养，其终末产物又可造成牙的破坏。其他糖类，如果糖（E错）、葡萄糖（B错）、麦芽糖（C错）和乳糖，能渗入牙菌斑生物膜,被细菌直接利用产酸，合成细胞壁多糖、荚膜多糖,但合成能力低于蔗糖。